全口义齿固位主要是靠
A. 附着力
B. 粘着力
C. 凝聚力
D. 舌及颊肌压力
E. 吸附力

正确答案：E。吸附力

解析：本题考查全口义齿的固位原理。固位是指义齿抵抗从口内垂直脱位的能力。全口义齿主要靠吸附力、表面张力和大气压力等物理作用固位（E对）。吸附力是两种物体分子之间的相互的吸引力，包括附着力（A错）和内聚力（B错）的作用。吸附力的大小与和黏膜之间的接触面积和密合程度有关系，接触面积越大、越密合，其吸附力也就越大。舌和颊肌压力（D错）是影响全口义齿稳定的重要因素。